可致皮肤癌的物质是
A. 乙腈
B. 沥青
C. 氯苯
D. 苯胺
E. 甲苯

正确答案：B。沥青